一定与系统性红斑狼疮的疾病活动性有关的免疫学检测指标是
A. 抗核抗体
B. 抗双链DNA抗体
C. 抗Sm抗体
D. 抗SSA抗体
E. 抗中性粒细胞胞浆抗体

正确答案：B。抗双链DNA抗体

解析：抗双链DNA抗体（B对）是诊断SLE的标记抗体之一，多出现在SLE的活动期，抗双链DNA抗体的含量与疾病活动性密切相关。抗核抗体（A错）见于几乎所有的SLE患者，由于特异性低，它的阳性不能作为SLE与其他结缔组织病的鉴别。抗Sm抗体（C错）是诊断SLE的标记抗体之一，有助于早期和不典型患者的诊断或回顾性诊断，但其与病情活动性不相关。抗SSA抗体（D错）（P818）往往在SCLE、SLE合并干燥综合征时有诊断意义。抗中性粒细胞胞浆抗体（E错）（P835）对血管炎的诊断和活动性判定有帮助。